治疗强心苷中毒引起的室性心律失常宜选用的药物是
A. 维拉帕米
B. 普罗帕酮
C. 胺碘酮
D. 普萘洛尔
E. 苯妥英钠

正确答案：E。苯妥英钠

解析：本题考查苯妥英钠的临床应用。苯妥英钠（E对）主要适用于治疗复杂部分性癫痫发作（颞叶癫痫、精神运动性发作）、单纯部分性发作（局限性发作）、全身强直阵挛性发作和癫痫持续状态。也用于治疗室上性或室性早搏，室性心动过速，尤适用于强心苷中毒时的室性心动过速。